柏子仁的功效是
A. 养心安神,润肠通便
B. 养心安神,敛汗
C. 养心安神,祛风通络
D. 安神解郁,活血消肿
E. 宁心安神,祛痰开窍

正确答案：A。养心安神,润肠通便

解析：柏子仁的功效是养心安神，润肠通便。应用于心悸失眠的治疗，本品味甘质润，药性平和，主入心经，具有养心安神的功效；本品质润，富含油脂，有润肠通便的功效（A对）。柏子仁性质甘润，能补阴以止汗，可用于治疗阴虚盗汗，但其不具有收敛作用（B错）。首乌藤有养心安神，祛风通络的功效（C错）。合欢皮有安神解郁，活血消肿的功效（D错）。远志具有宁心安神，祛痰开窍的功效（E错）。